可摘局部义齿出现弹跳现象的解决方法是
A. 修改卡环臂
B. 基托重衬
C. 基托缓冲
D. 重新排列人工牙
E. 修改卡环与支托，或重新制作卡环

正确答案：A。修改卡环臂

解析：弹跳：卡环臂尖未进入基牙的倒凹区，而是抵住邻牙，咬合时基托与黏膜贴合，开口时卡环的弹力使基托又离开黏膜。只要修改卡环臂即可纠正。掌握“局部义齿修复后出现的问题及处理”知识点。